属于污染物物理净化的过程有
A. 氧化还原作用
B. 分解作用
C. 中和作用
D. 活性污泥法
E. 沉淀作用

正确答案：E。沉淀作用

解析：本题考查污染物物理净化的过程。沉淀作用（E对）属于污染物物理净化的过程。沉淀是废水中悬浮物通过重力沉降作用，沉入池底污泥斗而被去除，常用的沉淀池有平流式、竖流式和斜板式沉淀池等形式。氧化还原作用（A错）、分解作用（B错）、中和作用（C错）属于化学净化的过程。活性污泥法（D错）属于生物净化的过程。